人体降钙素主要来源于
A. 甲状腺滤泡旁细胞
B. 甲状腺滤泡上皮细胞
C. 甲状旁腺主细胞
D. 成骨细胞
E. 破骨细胞

正确答案：A。甲状腺滤泡旁细胞

解析：人体降钙素（CT）由甲状腺C细胞（或称滤泡旁细胞）分泌（A对）。甲状腺滤泡上皮细胞（B错）分泌甲状腺激素。甲状旁腺主细胞（C错）分泌甲状旁腺激素。甲状旁腺激素可直接或间接作用于成骨细胞（D错）和破骨细胞（E错），升高血钙降低血磷。